川崎病的皮肤特征是
A. 丘疹样荨麻疹
B. 手足硬性水肿
C. 皮下小结
D. 湿疹样改变
E. 蝶形红斑

正确答案：B。手足硬性水肿

解析：川崎病（4）手足症状：急性期手足硬性水肿（B对）和掌跖红斑（5）皮肤表现：多形性皮斑和猩红热样皮疹（D错），常在第1周出现。风湿热的皮肤症状有（1）环形红斑：出现率为6%-25%。环形或半环形边界明显的淡色红斑，大小不等，中心苍白，出现在躯干和四肢近端，呈一过性，或时隐时现、呈迁徙性，可持续数周。（2）皮下小结（C错）：见于2%-16%的风湿热患儿，常伴有严重心脏炎，呈坚硬无痛结节，与皮肤不粘连，直接为0.1-1cm，出现肘膝腕踝等关节伸面，或枕部、前额头皮以及胸腰椎脊突的突起部位，约经2-4周消失。SLE（系统性红斑狼疮）80%患者在病程中出现皮疹，包括颊部呈蝶形分布的红斑（E错）、盘状红斑、指掌部和甲周红斑，指端缺血、面部及躯干皮疹，其中以鼻梁和双颧颊部呈蝶形分布的红斑最具特征性。